细菌侵入血液循环后大量繁殖并产生毒素，引起严重的全身中毒症状，称为
A. 菌血症
B. 毒血症
C. 败血症
D. 脓毒血症
E. 内毒素血症

正确答案：C。败血症

解析：败血症泛指细菌侵入血液循环后大量繁殖并产生毒素，引起严重的全身中毒症状，如高热、出血斑、肝脾肿大等。掌握“宿主的抗菌免疫及感染的发生发展”知识点。